医师处方必须遵循的原则是
A. 科学、诚实、信誉
B. 安全、有效、经济
C. 科学、有效、安全
D. 安全、有效、稳定
E. 科学、合理、经济

正确答案：B。安全、有效、经济

解析：本题考查医师处方必须遵循的原则。医师开具处方和药师调剂处方应当遵循安全、有效、经济（B对）的原则。